需用无菌检查法检查的吸入制剂有
A. 吸入气雾剂
B. 吸入喷雾剂
C. 吸入用溶液
D. 吸入粉雾剂
E. 吸入混悬液

正确答案：B、C、E。吸入喷雾剂；吸入用溶液；吸入混悬液

解析：本题考查需用无菌检查法检查的吸入制剂。需用无菌检查法检查的吸入制剂有吸入喷雾剂（B对）、吸入用溶液（C对）、吸入混悬液（E对）。吸入气雾剂（A错）和吸入粉雾剂（D错）无需无菌检查法检查。